砂仁薄层色谱鉴别所用的对照品是
A. 桉油精
B. 茴香醛
C. 醋酸龙脑酯
D. 大黄素、大黄酚
E. 士的宁

正确答案：C。醋酸龙脑酯